治疗立克次体感染宜选用的药物是
A. 青霉素
B. 链霉素
C. 四环素
D. 红霉素
E. 氨曲南

正确答案：C。四环素

解析：本题考查四环素。治疗立克次体感染宜选用四环素（C对）大环内酯类抗菌药红霉素（D错）也能用于立克次体感染，但应首选四环素。青霉素（A错）为β-内酰胺类抗生素，能破坏细菌的细胞壁并在细菌细胞的繁殖期起杀菌作用。氨基糖苷类抗菌药链霉素（B错）是治疗土拉菌病的首选药。氨曲南（E错）仅对需氧革兰阴性菌具有良好的抗菌活性。